高赖氨酸玉米提高了下列哪种氨基酸的含量
A. 亮氨酸
B. 色氨酸
C. 赖氨酸
D. 组氨酸
E. 精氨酸

正确答案：C。赖氨酸